患儿，男，3岁。夏季发病，发热1天，无汗，口渴烦躁，2分钟前突然抽搐。查体：体温40.2℃，舌红，苔黄，脉洪数。辨证为
A. 风热动风
B. 暑邪致惊
C. 温邪内陷
D. 湿热疫毒
E. 痰湿惊风

正确答案：B。暑邪致惊

解析：患儿，发热1天，2分钟前突然抽搐，体温40.2度，首先考虑为急惊风。惊风是小儿时期常见的一种以抽搐、神昏为特征的证候，分为急惊风和慢惊风，急惊风来势急骤，临床以高热伴抽搐、昏迷为特征，多由外感时邪疫疠以及暴受惊恐引起。夏季之时，气候炎热，由于小儿肌肤薄弱，腠理不密，故暑邪易袭，卫表失宣，故见发热，无汗；暑邪易耗气伤津，故口渴烦躁；婴幼儿内脏阴精不足，暑邪易于鸱张，化热化火，引动肝风，故见突然抽搐，故辨证为暑邪致惊证（B对）。风热动风（A错）证其临床表现为骤发高热，咳嗽流涕，乳蛾肿大，热甚抽搐，可伴神昏，舌红，苔薄黄，脉数，指纹紫。温邪内陷证（C错）其临床表现为面色苍白，四肢厥冷，手足躁动，颈项强直，两目上视，神昏谵语，舌红绛，脉细数或浮数，指纹青紫。湿热疫毒证（D错）其临床表现为突发高热，迅即神昏，反复抽搐，息促不匀，或腹痛呕吐，便下脓血，腥臭异常，舌红，苔黄腻，脉滑数，指纹紫滞。痰湿惊风（E错）其临床表现为先见纳呆，呕吐，腹痛，继而发热，迅即神昏抽搐，喉间痰鸣，呼吸气粗，苔黄厚而腻，脉弦滑，指纹紫滞。